下列哪项不属于闭经的病机
A. 气滞血瘀
B. 痰湿阻滞
C. 阴虚血燥
D. 气血虚弱
E. 湿毒壅盛

正确答案：E。湿毒壅盛

解析：湿毒壅盛证指感受外邪或体内水液运化失常而形成湿浊，阻遏气机于清阳，以身体困重，肢体酸痛，腹胀腹泻等为主要表现的症候，妇女可见带下量多（E对）。闭经原因归纳起来不外虚实两端，虚者，多因肾气不足，冲任亏虚；或肝肾亏损，精血不足，或脾胃虚弱，气血乏源而虚弱（D错）。或阴虚血燥，精亏血少，导致冲任血海空虚，源断其流，无血可下而致闭经（C错）。实者，多为气血阻滞、或痰湿流注下焦，使血流不畅，冲任阻滞，血海阻隔，经血不得下行而为闭经（AB错）。